6个月，男婴，人工喂养。平时易惊、多汗、睡眠少，近2日来咳嗽低热，今晨突然双眼凝视，手足抽搐。查体：枕后有乒乓球感。止抽后的处理是
A. 静滴钙剂
B. 供给氧气
C. 肌注呋塞米
D. 肌注维生素B
E. 静滴葡萄糖溶液

正确答案：A。静滴钙剂

解析：根据题干不难诊断患儿为营养性维生素D缺乏症，维生素D缺乏引起缺钙，导致惊厥抽搐，惊厥抽搐时应立即镇静解痉，随后针对病因治疗--静滴钙剂（A对）。抽搐时可给于吸氧，止抽后则无需吸氧（B错）。若考虑颅高压，一般选用静推甘露醇，而非肌注呋塞米（C错）。患儿无低血糖表现，无需静滴葡萄糖溶液（E错）。